应贮存于棕色容器内的药是
A. 硫糖铝片
B. 硫酸镁
C. 西咪替丁片
D. 硝酸甘油片
E. 兰索拉唑胶囊

正确答案：D。硝酸甘油片